被首选用于治疗风邪袭络头痛的腧穴是
A. 风池、百会、悬颅、侠溪、行间
B. 风池、太冲、合谷、内关、后溪
C. 百会、通天、行间、阿是穴
D. 上星、头维、合谷、阿是穴
E. 率谷、太阳、侠溪、内庭

正确答案：D。上星、头维、合谷、阿是穴

解析：风邪袭络头痛属于外感头痛，故治疗当以肺经相关腧穴及头部腧穴为主。上星、头维、阿是穴位于头部可调和头部气血，通络止痛；合谷为手阳明大肠经腧穴能疏散头部风邪，治疗风邪袭络之头痛（D对）。风池、百会、悬颅、侠溪、行间（A错）为治疗肝阳上亢头痛的腧穴；内关穴（B错）是手厥阴心包经腧穴，在前臂前区，腕掌侧远端横纹上3寸，掌长肌腱与桡侧腕屈肌腱之间；行间穴（C错）是足厥阴肝经上的穴位，位于足背，第1、2趾间，趾蹼缘后方赤白肉际处；侠溪穴为足少阳胆经腧穴，在足背，第4、5趾间，趾蹼缘后方赤白肉际处；内庭穴为足阳明胃经腧穴，位于足背第2、3趾间，趾蹼缘后方赤白肉际处（E错）。